58岁男性，自述左侧腮腺无痛性肿大7年余，触诊肿块不规则，活动度较差，质地中等偏硬，有囊性感。术中快速病理切片可见肿瘤实质由多边形的表皮样细胞和立方状的中间细胞构成，则此肿瘤的分型为
A. 高分化型（低度恶性型）
B. 中分化型（中度恶性型）
C. 低分化型（高度恶性型）
D. 筛孔型
E. 管状型

正确答案：C。低分化型（高度恶性型）

解析：本题考查唾液腺肿瘤。患者左侧腮腺无痛性肿大，肿块不规则，活动度差，质地中等偏硬，有囊性感。病理切片可见肿瘤实质由多边形的表皮样细胞和立方状的中间细胞构成，根据病人临床表现和病理表现能够诊疗此病为黏液表皮样癌的低分化型（C对）。黏液表皮样癌是由黏液细胞、中间细胞和表皮样细胞组成的恶性唾液腺上皮性肿瘤，镜下见肿瘤实质由黏液细胞、表皮样细胞和中间细胞组成。根据三种主要细胞成分的比率及细胞分化程度分为三种：①高分化（低度恶性）型（A错）：黏液细胞和表皮样细胞为主，中间细胞较少。②低分化(高度恶性)型：组成细胞主假如中间细胞和表皮样细胞，③中分（中度恶性）型（B错）：介于上述两型之间。筛孔型（D错）和管状型（E错）是腺样囊性癌的病理分型。